患者，女，41岁，BMI25，最新诊断为2型糖尿病，空腹血糖8.4mmol/L，餐后2小时血糖16mmol/L，血肌酐70㎛ol/L。若患者在服用首选降糖药物后，血糖仍未达标，临床考虑加用胰岛素增敏剂，可联合应用的药物是
A. 阿卡波糖
B. 瑞格列奈
C. 罗格列酮
D. 门冬胰岛素
E. 西格列汀

正确答案：C。罗格列酮

解析：本题考查罗格列酮。罗格列酮（C对）和吡格列酮为噻唑烷二酮类胰岛素增敏剂，其作用机制与特异性激活过氧化物酶体增殖因子激活的γ型受体（PPAR-γ）有关，提高组织对胰岛素的敏感性，提高组织摄取和利用葡萄糖从而降低血糖。